继发于大剂量应用抗生素后，大便为暗绿色水样便，镜检发现大量脓细胞，诊断是
A. 出血性大肠埃希菌肠炎
B. 真菌性肠炎
C. 金黄色葡萄球菌
D. 侵袭性大肠杆菌肠炎
E. 空肠弯曲菌肠炎

正确答案：C。金黄色葡萄球菌

解析：继发于大剂量应用抗生素后，大便为暗绿色水样便，镜检发现大量脓细胞，诊断是金黄色葡萄球菌（C对），出血性大肠埃希菌肠炎（A错）开始为黄色水样便，后转为血水便，有特殊臭味。真菌性肠炎（B错）的大便性质为黄色稀便，泡沫较多，带黏液，有时可见豆腐渣样细块（菌落）。侵袭性大肠杆菌肠炎（D错）大便呈黏液状，带脓血，有腥臭味。空肠弯曲菌肠炎（E错）大便性状为脓血状。